胶囊壳的主要成囊材料是
A. 阿拉伯胶
B. 淀粉
C. 明胶
D. 果胶
E. 西黄蓍胶

正确答案：C。明胶

解析：本题考查胶囊剂。明胶（C对）是空胶囊的主要成囊材料；阿拉伯胶（A错）广泛应用于制备各种水包油型乳状液体系；淀粉（B错）是很好的稀释剂、黏合剂、崩解剂；果胶（D错）、西黄蓍胶（E错）均为助悬剂。